女，45岁。反复双手近端指间关节、双膝关节痛，伴晨僵2年，肘部伸侧可触及皮下结节，质硬，无触痛。实验室检査：血RF1：40（﹢），ESR100mm/h。最有可能的诊断是
A. 风湿性关节炎
B. 类风湿关节炎
C. 系统性红斑狼疮
D. 骨性关节炎
E. 痛风

正确答案：B。类风湿关节炎

解析：中年女性患者（类风湿关节炎好发人群），反复双手近端指间关节、双膝关节痛（类风湿关节炎常见受累部位），伴晨僵2年，肘部伸侧可触及质硬、无痛性皮下结节（类风湿结节），RF（类风湿因子）阳性（80%左右类风湿关节炎可出现RF阳性），血沉加快，该患者最可能诊断为类风湿性关节炎（B对）。风湿性关节炎（A错）多见于5～15岁的儿童和青少年，其关节炎呈游走性，多发性，以膝、踝、肘、腕、肩等大关节受累为主（P805）。系统性红斑狼疮（C错）多见于20～40岁的育龄女性，80%患者在病程中出现皮疹，其中以鼻梁和双颧颊部呈蝶形分布的红斑最具特征，抗核抗体阳性，RF多为阴性（P816）。骨性关节炎（D错）主要累及膝、脊柱等负重关节，RF阴性或低滴度阳性（P858）。痛风（E错）以单侧第1跖趾关节受累最常见，可伴高尿酸血症（P861）。